镰状细胞贫血是因为血红蛋白β链基因上哪种突变引起的
A. 点突变
B. 插入
C. 缺失
D. 倒位
E. 移码突变

正确答案：A。点突变